某男，67岁。大便时溏时泻，水谷不化，泄泻多在黎明之前，腹痛喜暖，伴面色萎黄，肢倦乏力，形寒肢冷，腰膝酸软；舌淡苔白，脉迟弱。宜选用的中成药是
A. 人参归脾丸
B. 中满分消丸
C. 加味保和丸
D. 桂附理中丸
E. 人参健脾丸

正确答案：D。桂附理中丸

解析：本题考查的是泄泻肾阳虚衰证的中成药应用。某男，67岁。大便时溏时泻，水谷不化，泄泻多在黎明之前，腹痛喜暖，伴面色萎黄，肢倦乏力，形寒肢冷，腰膝酸软；舌淡苔白，脉迟弱。宜选用的中成药是桂附理中丸（D对）。泄泻肾阳虚衰证【症状】黎明前脐腹作痛，肠鸣即泻，泻后则安，完谷不化，腹部喜暖，形寒肢冷，腰膝酸软。舌淡苔白，脉沉细。【中成药应用】合理用药与用药指导桂附理中丸功偏补肾助阳，温中健脾，无涩肠之功，更适用于肾阳虚衰泄泻兼呕吐，四肢厥冷者。阳痿心脾两虚证【症状】阳痿不举；伴心悸，失眠多梦，神疲乏力，面色无华，食少纳呆，腹胀便溏。舌苔薄白，脉细弱。【中成药应用】人参归脾丸（A错）具有益气健脾，养血安神的作用，主治心脾两虚所致心悸、失眠等；刺五加脑灵液具有补益心脾，宁心安神的作用，主治心脾两虚所致失眠、健忘、乏力等。胃痛湿热中阻证【症状】胃脘疼痛，痛势急迫，脘闷灼热，口干口苦，口渴不欲饮，纳呆恶心，小便色黄，大便不畅。舌红，苔黄腻，脉滑数。【中成药应用】合理用药与用药指导中满分消丸（B错）健脾利湿力强，适用于脾虚气滞，湿热蕴结之中满热胀，二便不利，甚则出现鼓胀者。胃痛饮食伤胃证【症状】胃脘疼痛，胀满拒按，嗳腐恶食，或吐不消化食物，吐后或矢气后痛减，大便不爽。舌淡红，苔厚腻，脉滑。【中成药应用】合理用药与用药指导加味保和丸（C错）则消食的同时兼有健脾益胃之功，攻补兼施，相对平和，食积大便或结或泻者皆可用。泄泻脾胃虚弱证【症状】大便时溏时泻，迁延反复，食少，食后脘闷不舒，稍进油腻食物，则大便次数增多，面色萎黄，神疲倦怠。舌质淡，苔白，脉细弱。【中成药应用】合理用药与用药指导人参健脾丸（E错）组方中有炙当归补血活血止痛，炒酸枣仁、制远志宁心安神，更适用于思虑伤脾，脾胃虚弱之泄泻兼有饮食不化、不思饮食，腹痛明显者。